治疗慢性粒细胞性白血病，首选
A. 二溴甘露醇
B. 长春新碱
C. 靛玉红
D. 环磷酰胺
E. 羟基脲

正确答案：E。羟基脲

解析：按八版内科学观点，慢性粒细胞白血病的治疗首选分子靶向药物甲磺酸伊马替尼治疗，IFN-α（干扰素）是分子靶向药物出现之前的首选药物，羟基脲（E错）主要用于TKI（酪氨酸激酶抑制剂）和IFN-α均不耐受的患者以及用于高白细胞淤滞时的降白细胞处理，二溴甘露醇（A错）及靛玉红（C错）也是治疗慢性粒细胞性白血病的药物，但不是首选；长春新碱（B错）和环磷酰胺（D错）不用于慢性粒细胞白血病的治疗。本题无正确答案，但给出的参考答案为E。